现场试验的特点描述不正确的是
A. 研究对象通常为非患者
B. 研究地点为社区、学校、工厂等现场
C. 多为治疗性试验
D. 需以个体为单位随机分配措施
E. 尽可能应用盲法

正确答案：C。多为治疗性试验

解析：本题考查现场试验的特点。现场试验通常具有如下特点：1.研究对象通常为非病人（A对）；2.研究地点为社区、学校、工厂等现场（B对）；3.多为预防性试验（C错，为本题正确答案）；4.通常需要较多的研究对象；5.需以个体为单位随机分配措施（D对）；6.对分配的措施的不依从，应当测量其程度与原因；7.尽可能应用盲法（E对）。